津伤化燥多发生的脏腑是
A. 肝脾肾
B. 心肺胃
C. 脾胃小肠
D. 肺胃大肠
E. 肝肾大肠

正确答案：D。肺胃大肠

解析：肺胃生理特性都有喜润恶燥，大肠传化糟粕，且大肠主津，易津伤化燥，燥屎内结（D对）。肝体阴而用阳，津伤化燥不多，肾主水，主持调节水液代谢，脾喜燥恶湿，津伤化燥不常见，小肠主液津伤化燥不常见，三焦为为水道通行场所（ABCE错）。